阿司匹林的药理作用包括
A. 抗痛风
B. 抗风湿
C. 抗炎
D. 解热
E. 镇痛

正确答案：B、C、D、E。抗风湿；抗炎；解热；镇痛

解析：本题考查阿司匹林。阿司匹林为非甾体类抗炎药，能够抗风湿（B对）、抗炎（C对）、解热（D对）、镇痛（E对）。引起痛风（A错）的原因是高尿酸血症，常用的抗痛风药有：秋水仙碱、别嘌醇、丙磺舒等。